医患关系主要指
A. 医生与患者之间的关系
B. 护士与患者之间的关系
C. 医务人员与患者的关系
D. 包括了所有医疗中的人关系
E. 以上都不对

正确答案：C。医务人员与患者的关系

解析：医患关系是医护人员与患者之间相互联系、相互影响的沟通过程，是人际关系在医疗情境中的具体化形式。掌握“医患沟通的理论、技术与其应用以及医患关系模式”知识点。